胆固醇体内合成的原料是
A. 胆汁酸盐和磷脂酰胆碱
B. 17-羟类固醇和17-酮类固醇
C. 胆汁酸和维生素D等
D. 乙酰CoA和NADPH
E. 胆汁酸

正确答案：D。乙酰CoA和NADPH